对其他乙、丙类传染病患者和疑似患者，网络报告时限为
A. 1小时
B. 2小时
C. 6小时
D. 12小时
E. 24小时

正确答案：E。24小时

解析：本题考查传染病的报告时限。对其他乙、丙类传染病病人、疑似病人和规定报告的传染病病原携带者，实行网络直报的责任报告单位应于病例诊断后24小时（E对ABCD错）内进行网络报告。